决定法洛四联症临床严重程度及预后的主要因素是
A. 主动脉骑跨
B. 右心室肥大
C. 室间隔缺损
D. 肺动脉狭窄
E. 主动脉狭窄

正确答案：D。肺动脉狭窄

解析：法洛四联症是联合的先天性心血管疾病，包括肺动脉狭窄、心室间隔缺损、主动脉骑跨、右心室肥大四种异常，由于室间隔缺损为非限制性，左右心室压力基本相等，右心室流出道狭窄程度不同，心室水平可出现左向右、双向甚至右向左分流，肺动脉狭窄较轻者，可有左向右分流，此时患者无明显青紫，肺动脉狭窄严重，可出现明显的右向左分流，临床出现明显的青紫（青紫型法洛四联症），右心室流出道梗阻（肺动脉高压）使右心室负荷加重，引起右心室的代偿性肥厚。根据法洛四联症的病理生理特性，决定其临床严重程度及预后的主要因素是肺动脉狭窄（D对）。